处方用药不适宜的情况包括
A. 诺氟沙星用于消化不良性腹泻
B. 小檗碱用于降低血糖
C. 二甲双胍用于减轻体重
D. 克拉霉素联合阿奇霉素治疗上呼吸道感染
E. 人血白蛋白用于营养不良

正确答案：A、D。诺氟沙星用于消化不良性腹泻；克拉霉素联合阿奇霉素治疗上呼吸道感染

解析：本题考查用药不适宜处方。用药不适宜处方包括以下情况：适应证不适宜的（A错，为本题正确答案）；遴选的药品不适宜的；药品剂型或给药途径不适宜的；无正当理由不首选国家基本药物的；用法、用量不适宜的；联合用药不适宜的（D错，为本题正确答案）；重复给药的；有配伍禁忌或者不良相互作用的；其他用药不适宜情况的。小檗碱有一定降血糖功效，但盐酸小檗碱片不是专门降血糖药物（B错）。二甲双胍主要用于轻、中度2型糖尿病，尤其是单用饮食不能控制的伴有肥胖的患者（C对）。人血白蛋白可用于营养不良（E对），组织蛋白和血浆蛋白可互相转化，在氮代谢障碍时，白蛋白可作为氮源为组织提供营养。